男性，40岁。10年前曾行阑尾切除术。近2天来频繁呕吐、腹痛，无排便排气。查体时不会出现下列哪一项
A. 全腹膨隆
B. 腹壁静脉曲张
C. 肠鸣音为气过水声
D. 有轻压痛
E. 叩诊呈高度鼓音

正确答案：B。腹壁静脉曲张

解析：肠梗阻患者主要表现为腹痛、呕吐、腹胀、排气排便停止，本例患者有阑尾切除术病史，近两天来出现频繁呕吐、腹痛，无排便排气，考虑是由肠粘连引起肠梗阻所导致。肠梗阻患者腹部视诊时可见全腹膨隆（A对），部分患者可见到肠型和蠕动波。部分患者触诊时可有轻压痛（D对），叩诊时可呈高度鼓音（E对），听诊时可表现为肠鸣音亢进，有气过水声（C对）或金属音。腹壁静脉曲张（B错，为本题正确答案）是由门静脉高压致循环障碍或上下腔静脉回流受阻而有侧支循环形成所导致，常见于肝硬化患者。